急性颅内压增高时病人早期生命体征改变为
A. 血压升高，脉搏变缓，脉压变小
B. 血压升高，脉搏增快，脉压增大
C. 血压降低，脉搏变缓，脉压变小
D. 血压降低，脉搏增快，脉压变小
E. 血压升高，脉搏变缓，脉压增大

正确答案：E。血压升高，脉搏变缓，脉压增大

解析：急性颅内压增高时，病人早期生命体征改变为血压升高，脉搏变缓，脉压增大（E对）。首先由Cushing（1902）所描述，称为Cushing反应。